下列属于青春期女性的生理特点的是
A. 自18岁至48岁
B. 卵巢功能减退
C. 卵泡无雌激素分泌
D. 开始出现女性特征
E. 月经初潮

正确答案：E。月经初潮

解析：青春期为10～19岁（A错）（P13）。青春期生理特点包括乳房萌发、肾上腺素功能初现、生长加速、月经初潮（E对）（P14）。开始出现女性特征属于儿童期特点（D错）（P13）。卵巢功能减退属于绝经过渡期特点（B错），卵泡无雌激素分泌属于绝经后期特点（C错）（P14-P15）。